左心房内可见到
A. 腱索
B. 左房室口
C. 三尖瓣
D. 冠状窦口
E. 主动脉瓣

正确答案：B。左房室口

解析：左房室口（B对）可在左心房内可见到，其为左心室和左心房的交通。